肱骨中部骨折时易损伤
A. 正中神经
B. 腋神经
C. 桡神经
D. 尺神经
E. 骨间前神经

正确答案：C。桡神经

解析：正中神经（A错）易损伤部位为在前臂和腕部。腋神经（B错）易损伤部位为肱骨外科颈。桡神经（C对）易损伤部位为肱骨中段和桡骨颈处。尺神经（D错）易损伤部位为肘部肱骨内上髁后方、尺侧腕屈肌起点处和豌豆骨外侧。